乳房部脓肿切开引流正确的切口选择是
A. 乳晕旁弧形切口
B. 乳晕处放射状切口
C. 乳房下缘弧形切口
D. 以乳头为中心弧形切口
E. 以乳头为中心放射状切口

正确答案：E。以乳头为中心放射状切口

解析：切口选择一般以便于引流为原则，选择脓腔最低点或最薄弱处进刀，一般疮疡宜循经直切，免伤血络；乳房部的切开引流当以乳头为中心，循着乳络，放射状切开（E对）。乳晕部脓肿宜在乳晕旁做弧形切口（AB错）。乳房后位脓肿宜在乳房下方折皱部做弧形切口（CD错）。